男性，27岁。3月前患胸膜炎，经抽液、异烟肼+利福平+吡嗪酰胺治疗2个月，胸水吸收。2周来发热、咳嗽、痰血。X线检查示右上肺浸润性阴影，痰抗酸杆菌阳性。宜用哪种抗结核方案
A. 异烟肼、链霉素、乙胺丁醇
B. 异烟肼、利福平、吡嗪酰胺、链霉素、乙胺丁醇
C. 异烟肼、利福平、乙胺丁醇
D. 异烟肼、利福平、吡嗪酰胺
E. 异烟肼、利福平、吡嗪酰胺、氧氟沙星

正确答案：D。异烟肼、利福平、吡嗪酰胺

解析：胸水吸收说明原治疗方案有效。因为原先方案只用了2个月，一般疗程应为强化2个月，巩固4个月。故坚持使用原治疗方案：异烟肼+利福平+吡嗪酰胺。掌握“肺结核”知识点。